行首次口腔检查应在
A. 婴儿
B. 幼儿
C. 老年人
D. 中年人
E. 学龄前期

正确答案：A。婴儿

解析：本题考查婴幼儿口腔保健内容和方法。行首次口腔检查应在婴儿（A对）。婴幼儿口腔保健内容和方法：1.避免致龋菌早期定植。2.建立良好口腔清洁习惯。3.采用正确喂养姿势。4.养成良好饮食习惯。5.预防低龄儿童龋。6.预防乳牙外伤。7.定期口腔检查：儿童第一次口腔检查应在第一颗乳牙萌出后6个月内，或最迟在12个月之前。医师帮助判断儿童乳牙萌出情况并评估其患龋风险，提供有针对性的口腔卫生指导并建立口腔健康档案。定期口腔检查的另一个好处是使幼儿能逐渐熟悉和适应口腔科环境，与医护人员近距离的接触沟通，避免和减少日后口腔科就诊时的恐惧心理。易患根面龋的人群是老年人（C错）。第一恒磨牙窝沟封闭的适宜人群是学龄前期（E错）。